全球健康治理的功能不包括
A. 形成价值共识
B. 实现单一治理
C. 领导和协调功能
D. 制定规则、协调和规范行为
E. 动员和分配资金

正确答案：B。实现单一治理

解析：本题考查全球健康治理的功能。全球健康治理的功能包括：①形成价值共识（A对）；②领导和协调功能（C对）；③制定规则、协调和规范行为（D对）；④动员和分配资金（E对）；⑤实现多元治理（B错，为本题正确答案）。